大气的自净作用主要是
A. 物理作用
B. 化学作用
C. 生物学作用
D. 微生物学作用
E. 植物吸附作用

正确答案：A。物理作用

解析：本题考查大气的自净作用。大气的自净是指大气中的污染物在物理、化学和生物学作用下，逐渐减少到无害程度或者消失的过程。其中物理作用（A对BCDE错）是大气自净的主要作用，指大气中存在有害物质受到大气动力学作用（如上升运动、湍流等）的影响，发生物理性的分解、稀释、转移和吸收，从而减少对环境的污染。